判断疝是否绞窄的依据是
A. 疝内容物是否有血循环障碍
B. 疝局部是否有红肿或疼痛
C. 疝内容物是否能完全回纳
D. 嵌顿时间的长短
E. 有无肠梗阻表现

正确答案：A。疝内容物是否有血循环障碍

解析：绞窄疝指疝内容物嵌顿合并血液循环障碍，与嵌顿性疝实际上是一个病理过程的两个阶段。因此，判断疝是否绞窄的依据是疝内容物是否有血循环障碍（A对），与疝块嵌顿时间的长短无关（D错）。嵌顿性疝和绞窄性疝均可出现局部红肿或疼痛和肠梗阻表现；疝内容物能否回纳或能否完全回纳是难复性疝的诊断依据，因此，疝局部是否红肿或疼痛（B错）、疝内容物是否能完全回纳（C错）和有无肠梗阻表现（E错）均不能作为判断疝是否绞窄的依据。